下肢浅静脉曲张最主要的原因是
A. 盆腔内占位性病变
B. 长时间站立活动
C. 静脉壁薄弱
D. 妊娠后期子宫压迫
E. 髂股静脉血栓形成

正确答案：C。静脉壁薄弱

解析：下肢浅静脉曲张的主要原因是静脉壁薄弱（C对）、静脉瓣膜缺陷及浅静脉内压升高。长时间站立活动（B错）、盆腔内占位性病变（A错）及妊娠后期子宫压迫（D错）等引起的腹腔压力增高、髂股静脉血栓形成（E错）均是静脉内压升高的原因，瓣膜承受过度压力，在静脉瓣膜结构不良的情况下，逐渐松弛，进而导致瓣膜关闭不全，最终形成静脉曲张。